骨折的治疗原则是
A. 创口包扎
B. 迅速运输
C. 积极手术
D. 正确搬运
E. 复位固定功能锻炼

正确答案：E。复位固定功能锻炼

解析：骨折的治疗原则是复位、固定和康复治疗（即功能锻炼）（E对）。创口包扎（A错）、迅速运输（B错）、正确搬运（D错）均为骨折的急救原则。积极手术（C错）一般适用于开放性骨折合并血管和神经损伤的情况。